下列药品经营、使用行为，符合国家相关管理规定的是
A. 甲药店采取开架自选方式销售抗菌药物“头孢呋辛”
B. 乙药店以“凡购买5盒，附赠一盒”的方式促销甲类非处方药“多潘立酮”
C. 丙执业医师根据医疗需要推荐使用非处方药
D. 丁药品零售企业通过互联网向消费者销售精神药物“地西泮”
E. 戊药品批发企业销售药品时，以真实完整的销售记录代替销售凭证

正确答案：C。丙执业医师根据医疗需要推荐使用非处方药

解析：本题考查的是药品零售企业销售非处方药的要求。下列药品经营、使用行为，符合国家相关管理规定的是丙执业医师根据医疗需要推荐使用非处方药（C对）。药品零售企业销售非处方药的要求：药品零售企业可不凭医师处方销售非处方药，但执业药师或其他药学技术人员应当向个人消费者提供必要的药学服务，指导其合理用药或提出寻求医师治疗的建议。销售乙类非处方药时，执业药师或其他药学技术人员应当根据个人消费者咨询需求，提供科学合理的用药指导；销售甲类非处方药时，执业药师应当主动向个人消费者提供用药指导。药品零售企业不得采用开架自选的方式销售处方药（A错），也不得采用“捆绑搭售”“买商品赠药品”“买N赠1”“满N减1”“满N元减×元”等方式直接或变相赠送销售处方药、甲类非处方药（B错）（包括通过网络销售的渠道）。非人工自助售药设备不得销售除乙类非处方药外的其他药品。2019年8月新修订《药品管理法》规定，药品上市许可持有人、药品经营企业通过网络销售药品，应当遵守《药品管理法》中药品经营的有关规定；具体管理办法由国家药品监督管理局会同国务院卫生健康主管部门等部门制定；疫苗、血液制品、麻醉药品、精神药品、医疗用毒性药品、放射性药品、药品类易制毒化学品等国家实行特殊管理的药品不得在网上销售（D错）。药品零售企业销售药品应当开具销售凭证（E错），内容包括药品名称、生产厂商、数量、价格、批号、规格等，并做好销售记录。药品在售出时，应当执行追溯体系的规定。